关于高温和低温环境人群营养的叙述不正确的是
A. 高温和低温环境下机体能量消耗都增加
B. 高温环境下，钾的丢失高于钠的丢失
C. 高温和低温环境人群都应摄入充足的水分
D. 豆类食品可提供较多的蛋氨酸，有利于提高耐寒能力
E. 寒带居民增加维生素C、维生素E摄入量有利于提高耐寒能力

正确答案：B。高温环境下，钾的丢失高于钠的丢失

解析：本题考查高温和低温环境人群营养的相关内容。高温和低温环境下机体能量消耗都增加（A对），都应摄入充足的水分（C对）。高温环境下，钠的丢失高于钾的丢失（B错，为本题正确答案）。豆类食品可提供较多的蛋氨酸，有利于提高耐寒能力（D对）。寒带居民增加维生素C、维生素E摄入量有利于提高耐寒能力（E对）。